下列对信度与效度关系描述正确的是
A. 效度低，信度一定低
B. 效度高，信度一定高
C. 信度高，效度就高
D. 信度低，效度也可能高
E. 以上均不对

正确答案：B。效度高，信度一定高

解析：本题考查信度和效度的关系。信度和效度的关系是：1.不可信的测量一定是无效的。即信度不高，效度也不会高。2.可信的测量既可能有效，也可能无效。即信度高，效度不一定也高。3.无效的测量既可能是可信的，也可能是不可信的。即效度不高，信度可能高，也可能不高。4.有效的测量一定是可信的测量。即效度高，信度一定也高（B对ACDE错）。